卡托普利的作用原理是
A. 降低肾素活性
B. 抑制血管紧张素转化酶
C. 减少血管紧张素Ⅰ受体的生成
D. 抑制β羟化酶
E. 阻滞血管紧张素受体

正确答案：B。抑制血管紧张素转化酶

解析：卡托普利是血管紧张素转化酶抑制剂（B对E错），其作用机理就是抑制血管紧张素转化酶，阻止血管紧张素Ⅱ的生成（C错），从而取消其收缩血管、刺激醛固酮释放、增加血容量、升高血压与促心血管肥大增生等作用，适用于高血压、充血性心力衰竭、心肌梗死及糖尿病肾病的治疗。卡托普利并不降低肾素的活性（A错）。